面口部带状疱疹的典型临床表现
A. 成簇的红斑、水疱沿三叉神经对称分布，疼痛剧烈
B. 成簇的红斑、水疱沿一侧三叉神经分布，疼痛剧烈
C. 成簇的红斑、水疱沿一侧三叉神经分布，严重者可超过中线分布至对侧三叉神经，疼痛剧烈
D. 颜面部出现红斑，沿一侧三叉神经分布，继而出现水疱，继发感染后成为脓疱，最后结痂，脱痂后留下瘢痕
E. 以上都不

正确答案：B。成簇的红斑、水疱沿一侧三叉神经分布，疼痛剧烈

解析：本题考查带状疱疹的临床表现。带状疱疹是由水痘-带状疱疹病毒所引起的，以沿单侧周围神经分布的簇集性小水疱为特征，常伴有明显的神经痛。带状疱疹的典型临床表现是成簇的红斑、水疱沿一侧三叉神经分布，而不超过中线，侵犯神经，疼痛剧烈，常有神经痛（B对），愈合后常伴有带状疱疹后遗神经痛。成簇的红斑、水疱不是沿三叉神经对称分布（A错）而沿一侧三叉神经分布，且严重者损害不超过中线至对侧三叉神经（C错），因为三叉神经不与对侧交叉。由于病损未累及黏膜下层，水疱或脓疱脱痂后不留瘢痕（D错）。